以下哪项是一种具有遗传学基础的散发性骨疾病，还可作为McCune-Albright综合征的表征之一
A. 朗格汉斯细胞病
B. 慢性局灶性硬化性骨髓炎
C. 肉芽肿性唇炎
D. 纤维结构不良
E. 毛状白斑

正确答案：D。纤维结构不良

解析：纤维结构不良是一种具有遗传学基础的散发性骨疾病，可分为单骨性和多骨性，还可作为McCune-Albright综合征的表征之一。掌握“颌骨的非肿瘤性疾病”知识点。